下列物质中哪种属于刺激性气体
A. 一氧化碳
B. 水蒸气
C. 二氧化碳
D. 光气
E. 甲烷

正确答案：D。光气